下列有关mRNA结构的叙述，正确的是
A. 5＇端有多聚腺苷酸帽子结构
B. 3＇端有甲基化鸟嘌呤尾结构
C. 链的二级结构为单链卷曲和单链螺旋
D. 链的局部可形成双链结构
E. 三个相连核苷酸组成一个反密码子

正确答案：D。链的局部可形成双链结构

解析：RNA通常以单链形式存在，但可以通过链内的碱基配对形成局部的双链二级结构和空间的高级结构（D对C错）。大部分真核细胞mRNA的5＇-端有一反式的７-甲基鸟嘌呤-三磷酸核苷，被称为5＇帽结构（A错）。mRNA的3＇-端有多聚腺苷酸结构，称为多聚腺苷酸尾或多聚A尾（B错）。mRNA上存在的3个相连核苷酸组成三联体密码子，反密码子存在于tRNA分子上（E错）。